《处方药与非处方药流通管理暂行规定》要求执业药师或药师
A. 对处方进行审核、签字
B. 拒绝调配、销售有副作用的处方
C. 拒绝调配、销售有配伍禁忌的处方
D. 对处方不得擅自更改或代用
E. 拒绝调配、销售超剂量的处方

正确答案：A、C、D、E。对处方进行审核、签字；拒绝调配、销售有配伍禁忌的处方；对处方不得擅自更改或代用；拒绝调配、销售超剂量的处方

解析：本题考查处方药与非处方。《处方药与非处方药流通管理暂行规定》第十条：执业药师或药师必须对医师处方进行审核、签字（A对）后依据处方正确调配、销售药品。对处方不得擅自更改或代用（D对）。对有配伍禁忌（C对）或超剂量（E对）的处方，应当拒绝调配、销售，必要时，经处方医师更正或重新签字，方可调配、销售。